检查氟康唑含量的方法是
A. 分子排阻色潽法
B. 四氮唑比色法
C. 抗生素微生物法
D. 氧瓶燃烧比色法
E. 红外分光光度法

正确答案：D。氧瓶燃烧比色法

解析：本题考查氟康唑的含量测定方法。氧瓶燃烧比色法（D对）是将有机药物在充满氧气的燃烧瓶中进行燃烧，待燃烧产物被吸入吸收液后，再采用适宜的分析方法来检查或测定卤素或硫等元素的含量。